患者男性，55岁，因右上颌牙痛三天，右侧眼下、鼻侧肿胀一天而就诊。检查：右侧上颌尖牙远中深龋，探（-），叩（++），松动（-），前庭沟肿胀变浅，同侧鼻侧、眶下区肿胀明显，局部皮温增高，压痛和波动感存在，眼裂变小。体温40℃，食欲下降，精神萎靡。该患者最有可能的诊断为右侧眶下间隙感染，最可能的直接病因为右上颌尖牙根尖周炎，该患者此时最适当的治疗方案是局部切开引流，配合全身抗感染，该患者外科治疗的切口应选择在右上颌尖牙前庭沟黏膜转折处，该患者感染扩散可能引起的严重并发症为：
A. 咬肌间隙感染
B. 颌下间隙感染
C. 翼颌间隙感染
D. 上颌窦炎
E. 海绵窦血栓性静脉炎

正确答案：E。海绵窦血栓性静脉炎

解析：本题考查眶下间隙感染的严重并发症。眶下间隙与颊间隙相通，常向上向眶内直接扩散，形成眶内蜂窝织炎，亦可沿面静脉、内眦静脉、眼静脉向颅内扩散，并发海绵窦血栓性静脉炎。海绵窦血栓性静脉炎（E对）可引起颅内高压，严重时危及生命，是眶下间隙感染的严重并发症。